脊髓前角细胞损伤，会造成其所支配的
A. 对侧骨赂肌的张力减弱，腱反射消失
B. 同侧骨骼肌的张力减弱，腱反射消失
C. 对侧骨骼肌的张力加强，腱反射亢进
D. 同侧骨骼肌的张力加强，腱反射亢进
E. 无

正确答案：B。同侧骨骼肌的张力减弱，腱反射消失

解析：脊髓前角细胞损伤，表现为因失去神经直接支配所致：①随意运动障碍；②同侧骨骼肌的张力减弱，故又称弛缓性瘫痪（软瘫）；③浅反射和深反射都消失（因所有反射弧均中断）；④也不出现病理反射。综上，脊髓前角细胞损伤，会造成其所支配的同侧骨骼肌的张力减弱，腱反射消失（B对）。